黄芪桂枝五物汤用于治疗产后关节痛
A. 气虚证
B. 血虚证
C. 血凝证
D. 肾虚证
E. 外感证

正确答案：B。血虚证

解析：产后关节痛的血虚证治宜养血益气，温经通络，选用黄芪桂枝五物汤（B对）。血瘀证（C错）宜选用生化汤来养血活络，行瘀止痛。外感证（E错）宜选用独活寄生汤来养血祛风，散寒除湿。